不能补充血糖的生化过程是
A. 食物中糖类的消化吸收
B. 肌糖原分解
C. 糖异生
D. 肝糖原分解
E. 葡萄糖在肾小管的重吸收

正确答案：B。肌糖原分解

解析：血糖的主要来源有：食物中糖类的消化吸收（A对）、糖异生（C对）、肝糖原分解（D对）、葡萄糖在肾小管的重吸收（E对）。因肌组织中缺乏葡糖-6-磷酸酶，葡糖-6-磷酸只能进行糖酵解，故肌糖原分解（B错，为本题正确答案）不能补充血糖，只能给肌收缩提供能量。